既能合成甘油三酯又能吸收、储存食物中的甘油三酯的是
A. 肝细胞
B. 脂肪细胞
C. 小肠
D. 肾脏
E. 胆囊

正确答案：B。脂肪细胞

解析：脂肪细胞不但可以合成甘油三酯，还能将食物中消化吸收的外源性甘油三酯一并贮存起来，作为能量“仓库”供机体禁食或饥饿时所需。掌握“甘油磷脂、胆固醇和血脂蛋白代谢”知识点。